补中益气丸具有补中益气、升阳举陷的功能。方中君药黄芪宜选用的饮片是
A. 炙黄芪
B. 生黄芪
C. 酒黄芪
D. 焦黄芪
E. 炒黄芪

正确答案：A。炙黄芪

解析：本题考查的是黄芪的炮制作用。补中益气丸具有补中益气、升阳举陷的功能。方中君药黄芪宜选用的饮片是炙黄芪（A对）。黄芪：【炮制作用】黄芪味甘，性温。归肺、脾经。具有补气固表，利尿托毒，排脓，敛疮生肌的功能。①生品（B错）长于益卫固表，托毒生肌，利尿退肿。常用于表卫不固的自汗或体虚易于感冒，气虚水肿，痈疽不溃或溃久不敛。②炙黄芪甘温而偏润，长于益气补中。多用于脾肺气虚，食少便溏，气短乏力或兼中气下陷之久泻脱肛、子宫下垂以及气虚不能摄血的便血、崩漏等出血症；也可用于气虚便秘。酒黄芪（C错）、焦黄芪（D错）与炒黄芪（E错）的炮制作用，2022年考试指南未明确说明。